《医疗废物管理条例》中所称医疗废物，是指医疗卫生机构在医疗、预防、保健及其他相关活动中产生的
A. 麻醉、精神性药品的废弃物
B. 放射性、医疗用毒性药品的废弃物
C. 具有直接或间接感染性、毒性以及其他危害性的废物
D. 医院制剂配制中产生的中药材废渣
E. 普通医疗生活用品废弃物

正确答案：C。具有直接或间接感染性、毒性以及其他危害性的废物

解析：《医疗废物管理条例》中所称医疗废物，是指医疗卫生机构在医疗、预防、保健及其他相关活动中产生的具有直接或间接感染性、毒性以及其他危害性的废物（C对）。麻醉、精神药品的废弃物（A错）、放射性、医疗用毒性药品的废弃物（B错）、医院制剂配制中产生的中药材废渣（D错）均属于具有直接或间接感染性、毒性以及其他危害性的废物。普通医疗生活用品废弃物属于生活垃圾（E错）。